重度脱水合并休克首选治疗措施是
A. 静脉补液
B. 口服补液
C. 饮食疗法
D. 药物治疗
E. 病因治疗

正确答案：A。静脉补液

解析：静脉补液（A对）是重度脱水合并休克时的首选治疗措施，因为重度脱水合并休克时有效血容量不足，引起组织低灌注和缺氧，若不及时纠正可发生一系列器官损伤，及时静脉补液可恢复组织灌注。口服补液（B错）、饮食疗法（C错）、药物治疗（D错）、病因治疗（E错）都不能在第一时间及时补充血容量，故不作为休克时的首选治疗措施。